能用于注射剂精滤的方法是
A. 鲎试验法
B. 气泡点法
C. 超滤法
D. 吸附法
E. 反渗透法

正确答案：C。超滤法

解析：本题考查去除热原的方法。能用于注射剂精滤的方法是超滤法（C对）。热原是微生物产生的一种细菌内毒素，可以引起动物和人体温度异常升高，应根据热原的基本性质和可能被污染的途径采用一定的方法除去。超滤法是采用微孔高分子滤膜，在一定条件下利用一定的压力和流速将热原除去，一般使用3～15nm的超滤膜。鲎试验法（A错）一般用来进行细菌内毒素的检查。气泡点法（B错）常用于检查微孔滤膜孔径的大小。吸附法（D错）和反渗透法（E错）用于注射剂中去除热原。